下列各项，不属于发的临床特点的是
A. 初起仅有单个脓头
B. 红肿蔓延成片
C. 灼热疼痛
D. 全身症状明显
E. 红肿中央明显，四周较淡

正确答案：A。初起仅有单个脓头

解析：发是病变范围较痈大的急性化脓性疾病，其特点是初起无头（A对），红肿蔓延成片（B错），中央明显，四周较淡（E对），边界不清，灼热疼痛（C错），有的3~5日后中央色褐腐溃，周围湿烂，全身症状明显（D错）。